七厘散组方中的君药是
A. 乳香（制）
B. 人工麝香
C. 儿茶
D. 红花
E. 血竭

正确答案：E。血竭

解析：本题考查七厘散的方义简释。七厘散组方中的君药是血竭（E对）。七厘散【方义简释】方中血竭甘咸走血，性平不偏，行中有止，既善活血化瘀止痛，又善止血生肌敛疮，故重用为君药。制乳（A错）辛香走窜，苦泄温通，善活血止痛、消肿生肌；制没药苦平泄散，辛香走窜，善破血止痛、消肿生肌；红花（D错）辛散温通，善活血祛瘀消肿；儿茶（C错）苦寒清泄涩敛，善解毒敛疮、生肌止血。四药相合，有助君药化瘀消肿、止痛止血之功，故为臣药。冰片辛香走窜，苦泄微寒，《本草正》云其“散气、散血、通窍”，并善消肿生肌、清热止痛；人工麝香（B错）性效同麝香，其辛香散窜温通，善活血通经、消肿止痛；朱砂质重镇怯，甘寒清解，有毒力强，善镇心安神、清热解毒，并能防腐。三药相合，既助君臣药之功，又清热镇心安神，消除伤损瘀热所致的气血紊乱、心神不宁，故为佐药。全方配伍，行散与涩敛并施，共奏化瘀消肿止痛、止血生肌敛疮之功，故善治跌仆损伤、血瘀疼痛及外伤出血。